在杂质定量测定方法验证中常用信噪比确定定量限，一般要求定量限的信噪比为（S/N）
A. 100∶1
B. 10∶1
C. 1∶1
D. 1∶10
E. 1∶100

正确答案：B。10∶1

解析：本题考查定量限常用的方法。定量限（LOQ）系指试样中被测物质能被定量测定的最低量，其测定结果应符合准确度和精密度要求。常用信噪比法，要求信噪比为10∶1（B对）。